下列处方的制定标准描述中，错误的是
A. 西药和中成药不可以开具一张处方
B. 每张处方不得超过5种药品
C. 开具处方完毕后的空白处画一斜线
D. 中药饮片应当单独开具处方
E. 新生儿、婴幼儿写日、月龄，必要时要注明体重

正确答案：A。西药和中成药不可以开具一张处方

解析：西药和中成药可以分别开具处方，也可以开具一张处方，中药饮片应当单独开具处方。掌握“处方管理概述及一般规定、处方权”知识点。